将餐具在水中煮沸（100℃）5分钟，可达到
A. 消毒
B. 灭菌
C. 防腐
D. 无菌
E. 抑菌

正确答案：A。消毒

解析：煮沸法：在1个大气压下，将水煮沸（100℃）5分钟，可杀灭细菌繁殖体，如加入2%碳酸钠，可提高沸点至105℃并可防锈，常用于餐具及一些医疗器皿的消毒。掌握“消毒与灭菌”知识点。